处方药管理内容包括
A. 药店药学技术或管理人员配备要求
B. 易出现药物滥用
C. 药品定价
D. 药品储备
E. 药品名称、包装、标签和说明书

正确答案：A。药店药学技术或管理人员配备要求